患者，女，47岁，因慢性阻塞性肺疾病使用布地奈德-福莫特罗粉吸入剂，每天2次，每次1吸。患者用药时，自觉未吸入药物，于是重复操作十余次，之后出现心慌、手抖等不适症状。考虑是由于操作不当而误吸入过量福莫特罗所致。药师先请患者演示干粉吸入器的使用方法，针对发现的问题给予用药指导，下列说法正确的有
A. 在深吸气将药物吸入后，立即恢复正常呼吸
B. 因为药物颗粒非常小，以至于经常感觉不到，可以通过黑布试验证明药物是否被吸入
C. 用药时应有力且深长地吸气，确保药物被充分吸入肺中
D. 为避免口腔念珠菌感染，建议每次用药后及时用水漱口
E. 装置初始化后，每转动一次，听到“咔嗒”声响，即表示单次装药完成，不应连续转动

正确答案：B、C、D。因为药物颗粒非常小，以至于经常感觉不到，可以通过黑布试验证明药物是否被吸入；用药时应有力且深长地吸气，确保药物被充分吸入肺中；为避免口腔念珠菌感染，建议每次用药后及时用水漱口

解析：本题考查布地奈德福莫特罗粉吸入器的使用。布地奈德福莫特罗粉吸入器使用时应注意：（1）用药时应有力且深长地吸气，确保药物充分吸入肺中（C对）；（2）因为药物颗粒非常小，以至于经常感觉不到，可以通过黑布试验证明药物是否被吸入（B对）；为避免口腔念珠菌感染，建议每次用药后，用水漱口（D对）。布地奈德福莫特罗粉吸入器的使用方法：（1）在首次使用吸入器时，都需要对吸入器装置进行初始化，初始化的步骤如下：首先旋松并拔出瓶盖，确保红色的旋柄在下方；其次拿直吸入器，握住红色旋柄部分吸入器中间的部分，向一个方向旋转到底，再其反方向旋转到底。在这一过程中，会听到有“咔哒”一声，然后再重复以上步骤一次（E错），吸入器的初始化操作就完成了；（2）缓慢的呼气，但是不可以对着吸入器吸嘴呼气；（3）把吸嘴置于齿间，双唇包住吸嘴，用力且深长地用嘴吸气；将吸嘴从嘴部移开，屏气5秒钟后恢复正常的呼吸（A错）；（4）如果处方中需要多次剂量，就需要重复以上的步骤；（5）在吸入药物之后，用清水漱口，去除上咽部残留的药物；（6）用药完毕，无需再次旋动旋柄，只需要擦干外咬嘴，旋紧瓶盖即可。